鼠疫耶尔森菌的传播媒介是
A. 鼠蚤
B. 鼠虱
C. 螨
D. 蚊
E. 蜱

正确答案：A。鼠蚤

解析：鼠疫是自然疫源性烈性传染病，人类鼠疫由带菌的鼠蚤叮咬而受染。人患鼠疫后，又可通过人蚤或呼吸道等途径在人群中流行。掌握“动物源性细菌”知识点。